患者，女，38岁，已婚。近几年形体渐胖，胸闷呕恶，倦怠乏力，月经停闭半年，平时带下量多色白，舌淡胖苔白腻，脉沉滑，尿妊娠试验阴性。治疗应首选
A. 血府逐瘀汤
B. 苍附导痰丸
C. 参苓白术散
D. 开郁二陈汤
E. 香砂六君子汤

正确答案：B。苍附导痰丸

解析：该患者月经停闭半年，妊娠试验阴性，故诊断为闭经。患者形体渐胖，肥人多痰湿，痰湿下注，壅滞冲任，有碍血海满盈，故月经停闭半年；痰湿内停，滞于胸脘，故胸闷呕恶；痰湿之邪困伤脾阳，故倦怠乏力；痰湿伤及任带二脉，故带下量多色白。舌淡胖，苔白腻，脉沉滑均为痰湿之象，故辨为痰湿阻滞证，治宜健脾燥湿化痰，活血调经。方选四君子汤合苍附导痰丸。血府逐瘀汤功能活血化瘀，行气止痛，主治胸中血瘀证（A错）。苍附导痰丸功能燥湿健脾，行气消痰，为闭经痰湿阻滞证的选方（B对）。参苓白术散功能益气健脾，渗湿止泻，主治脾虚湿盛证（C错）。开郁二陈汤功能行气解郁，主治气郁经闭证（D错）。香砂六君子汤功能益气健脾，行气化痰，主治脾胃气虚，痰阻气滞证（E错）。